可参考哮喘证辨证论治的西医疾病是
A. 上呼吸道感染
B. 多种神经症
C. 慢性肾脏疾病
D. 肺源性心脏病
E. 胃食管反流病

正确答案：D。肺源性心脏病

解析：本题考查的是喘证。可参考哮喘证辨证论治的西医疾病是肺源性心脏病（D对）。喘证是以呼吸困难，甚至张口抬肩、鼻翼扇动、不能平卧为特征的疾病。西医学的肺炎、支气管炎、肺气肿、肺源性心脏病、心源性哮喘以及癔病等发生呼吸困难时，可参考此内容辨证论治。上呼吸道感染（A错）可参考感冒辨证论治。感冒是感受风邪或时行病毒，卫表失和而导致的常见外感疾病，临床表现以鼻塞、流涕、喷嚏、头痛、恶寒、发热、全身不适、脉浮等为特征。西医学中普通感冒（伤风）、流行性感冒（时行感冒）及其他上呼吸道感染，有上述临床表现者可参考此内容辨证论治。多种神经病（B错）、慢性肾脏疾病（C错）与胃食管反流病（E错）可参考辨证论治的疾病，2022年考试指南未明确说明。